维持细胞内液渗透压的离子最主要的是
A. K⁺
B. Na⁺
C. Mg²⁺
D. Ca²⁺
E. HPO₄²⁻

正确答案：A。K⁺

解析：维持细胞内液渗透压的离子主要是K⁺（A对），其次是HPO₄²⁻（E错）。Na⁺（B错）、Ca²⁺（D错）、Mg²⁺（C错）浓度都低于K⁺，所产生的渗透压也较低。